某医师治产后瘀阻腹痛，伴小便不利，常选用牛膝，是因其能
A. 活血，止血
B. 活血，凉血
C. 活血，利尿
D. 活血，行气
E. 活血，通便

正确答案：C。活血，利尿

解析：本题考查的是牛膝的功效。某医师治产后瘀阻腹痛，伴小便不利，常选用牛膝，是因其能活血，利尿（C对）。牛膝：【功效】活血通经，利尿通淋，引血下行，补肝肾，强筋骨。五灵脂：【功效】活血止痛，化瘀止血（A错），解蛇虫毒。丹参：【功效】活血祛瘀，通经止痛，清心除烦，凉血（B错）消痈。川芎：【功效】活血行气（D错），祛风止痛。虎杖：【功效】利湿退黄，清热解毒，活血祛瘀，化痰止咳，泻下通便（E错）。